以下关于牙体预备中牙髓保护的说法哪项是错误的
A. 牙体预备分次完成
B. 轻压磨切
C. 尽量少磨牙
D. 预备时间歇、短时磨切
E. 水雾冷却

正确答案：A。牙体预备分次完成

解析：本题考查牙体预备过程中注意保护软硬组织健康-保护牙髓。牙体预备过程中要注意保护牙髓，要求尽量一次完成（A错，为本题的正确答案），牙在短期内做二次预备，会增加患者痛苦，损伤也较大，不利于保护牙髓，应尽量避免。轻压磨切（B对）、预备时间歇、短时磨切（D对）、水雾冷却（E对）都是为了降低磨切时的温度，减少对牙髓的刺激，有利于保护牙髓。尽量少磨牙（D对）符合生物学原则，保留越多牙体硬组织对牙髓保护越有利。